不属于小细胞性贫血的是
A. 缺铁性贫血
B. 海洋性贫血
C. 慢性感染性贫血
D. 铁粒幼细胞性贫血
E. 再生障碍性贫血

正确答案：E。再生障碍性贫血

解析：贫血按照红细胞形态分大细胞性贫血、正常细胞性贫血和小细胞性贫血。小细胞性贫血的特点是红细胞平均体积＜80fl，红细胞平均血红蛋白＜27pg，红细胞平均血红蛋白浓度＜32%。常见疾病有：缺铁性贫血（A错）、海洋性贫血（P555）（B错）（又称珠蛋白生成障碍性贫血）、慢性感染性贫血（P543）（C错）、铁粒幼细胞性贫血（D错）等。再生障碍性贫血（P547）（E对）是一组由不同病因和机制引起的骨髓造血功能衰竭，属于正常细胞性贫血。